随机选择5岁组儿童100名进行免疫接种预防试验，观察了8年，结果表明有70%的免疫接种者未患所研究的疾病。对此研究，下列哪个观点正确
A. 该疫苗有效，因为有70%的儿童未患此疾病
B. 该疫苗无效，因为有30%的儿童患了此疾病
C. 不能下结论，因为未进行统计学检验
D. 不能下结论，因为未设对照组
E. 不能下结论，因为观察时间不够长

正确答案：D。不能下结论，因为未设对照组

解析：本题考查设立对照的必要性。当面对一些疾病自然史不清楚的疾病，其“疗效”也许是疾病发展的自然结果，不设立可比的对照组（D对ABCE错），则很难与治疗措施的真实疗效区分开来。题中的实验未设立没有进行免疫接种的对照组，该实验无意义。